功能失调性子宫出血发病因素不包括
A. 下丘脑-垂体-卵巢轴功能紊乱
B. 由于器质性病变引起
C. 环境变化
D. 气候骤变、过度劳累
E. 营养不良

正确答案：B。由于器质性病变引起

解析：本题考查功能失调性子宫出血的发病因素。更年期妇女的月经紊乱主要原因是因下丘脑-垂体-卵巢轴功能紊乱（A对），出现排卵障碍，部分也有营养不良（E对）、环境变化（C对）、气候骤变、过度劳累等（D对）因素，并非是因为生殖器官的器质性疾病（B错，为本题正确答案）或因全身性疾病引起的月经变化，所以这个时期的功血一般归类为无排卵性功能失调性子宫出血.